正确描述膈神经的是
A. 发自第1、2腰神经的前支部分纤维
B. 发自第3、4、5颈神经前支部分纤维
C. 是运动性神经
D. 只支配膈肌
E. 经心包后面下降至膈

正确答案：B。发自第3、4、5颈神经前支部分纤维

解析：膈神经发自第3、4、5颈神经前支部分纤维（A错B对）。入胸腔后有心包膈血管与其伴行，经由肺根前方，在纵膈胸膜与心包之间下行到达膈肌（E错），最后于中心腱附近穿入膈肌纤维中。膈神经的运动纤维支配膈肌的运动，感觉纤维分布于胸膜、心包以及膈肌下面的部分腹膜（CD错）。